对骨质疏松症有治疗作用的药物有
A. 盐酸雷洛昔芬
B. 阿法骨化醇
C. 阿仑膦酸钠
D. 利塞膦酸钠
E. 依替膦酸二钠

正确答案：A、B、C、D、E。盐酸雷洛昔芬；阿法骨化醇；阿仑膦酸钠；利塞膦酸钠；依替膦酸二钠

解析：本题考查骨质疏松症治疗药。对骨质疏松症有治疗作用的药物有盐酸雷洛昔芬（A对）、阿法骨化醇（B对）、阿仑膦酸钠（C对）、利塞膦酸钠（D对）、依替膦酸二钠（E对）。从机制出发，骨质疏松药可分为两类：（1）抑制骨吸收药：包括双膦酸盐类（依替膦酸二钠、氯屈膦酸二钠、帕米膦酸二钠、阿仑膦酸钠、伊班膦酸钠、利塞膦酸钠等），替勃龙。雌激素类（结合雌激素、微粒化17β-雌二醇），依普黄酮，雷洛昔芬，降钙素等。（2）刺激骨形成药：包括氟制剂（氟化钠、一氟膦酸二钠、一氟磷酸谷氨酰胺等），甲状旁腺激素，生长激素，骨生长因子等。此外，钙剂（如碳酸钙）、维生素D及其活性代谢物（如骨化三醇、阿法骨化醇）可促进骨的矿化，对抑制骨的吸收、促进骨的形成也起作用。